何者错误
A. 是两层硬脑膜形成的
B. 位于大脑镰上缘
C. 其内血液流入窦汇
D. 位于大脑镰下缘
E. 是脑脊液回流处

正确答案：D。位于大脑镰下缘

解析：上矢状窦属于硬脑膜窦，是某些部位由两层硬脑膜形成的（A对），位于大脑镰上缘（B对D错，为本题正确答案）内。上矢状窦内面衬以内皮细胞，窦内含静脉血，回流入窦汇（C对），并最终回流至颈内静脉。上矢状窦内有脑蛛网膜形成的绒毛状突起，称蛛网膜粒。脑脊液通过这些蛛网膜粒渗入硬脑膜窦内，回流入静脉，因而上矢状窦是脑脊液回流处（E对）。